感染性心内膜炎最常见的症状是
A. 心率失常
B. 脾大
C. Osler结
D. 发热
E. 贫血

正确答案：D。发热

解析：发热是感染性心内膜炎最常见的症状，除有些老年人或心、肾衰竭重症患者外，几乎均有发热。掌握“自体瓣膜感染性心内膜炎”知识点。